中药毒性反应引起生理生化功能异常和病理变化，可在各系统内发生，造成多系统的脏器的损害。关于中药发生毒性反应的机制和表现的说法，正确的有
A. 山药丸含马钱子，马钱子主要有毒成分为番木鳖碱，可首先兴奋神经系统，引起脊髓强直性痉挛，继而兴奋呼吸中枢及血管运动中枢，可因呼吸肌痉挛窒息或心力衰竭而死亡
B. 舒筋丸含乌头，乌头的主要成分为乌头碱，其毒性主要用于神经系统，尤其是迷走神经，并可直接作用于心脏，可致心律失常，甚至引起室颤和死亡
C. 牛黄至宝丸含朱砂，朱砂的主要成分为汞，机体吸收和迅速弥散到各个器官和组织，并可通过血脑屏障进入脑组织，产生各种中毒症状
D. 人参再造丸含雄黄，雄黄的主要成分为砷盐，砷盐毒性较大，进入人体后蓄积和分布于体内各组织，主要在肝、肾、脾等内脏及指甲、毛发等部位，产生一系列中毒症状
E. 梅花点舌丸含蟾酥，蟾酥的主要有毒成分为蟾酥毒素，具有洋地黄样作用。小剂量能使心肌缩力增强，大剂量则使心脏停止收缩期

正确答案：A、E。山药丸含马钱子，马钱子主要有毒成分为番木鳖碱，可首先兴奋神经系统，引起脊髓强直性痉挛，继而兴奋呼吸中枢及血管运动中枢，可因呼吸肌痉挛窒息或心力衰竭而死亡；梅花点舌丸含蟾酥，蟾酥的主要有毒成分为蟾酥毒素，具有洋地黄样作用。小剂量能使心肌缩力增强，大剂量则使心脏停止收缩期

解析：本题考查的是医疗用毒性中药的中毒反应。关于中药发生毒性反应的机制和表现的说法，正确的有山药丸含马钱子，马钱子主要有毒成分为番木鳖碱，可首先兴奋神经系统，引起脊髓强直性痉挛，继而兴奋呼吸中枢及血管运动中枢，可因呼吸肌痉挛窒息或心力衰竭而死亡（A对）；梅花点舌丸含蟾酥，蟾酥的主要有毒成分为蟾酥毒素，具有洋地黄样作用。小剂量能使心肌缩力增强，大剂量则使心脏停止收缩期（E对）。医疗用毒性中药的中毒反应：一、乌头类药物：（一）乌头类药物和含乌头类药物的中成药：1.中药材：川乌、草乌、附子、雪上一枝蒿等。2.中成药：追风丸、追风透骨丸、三七伤药片、附子理中丸、金匮肾气丸、木瓜丸、小金丸、风湿骨痛胶囊、祛风止痛片、祛风舒筋丸、正天丸、右归丸等。（一）中毒机制：主要有毒成分为乌头碱，一般中毒量为0.2mg，致死量为2～4mg。其毒性主要作用于神经系统，尤其是迷走神经等，使其先兴奋后抑制，并可直接作用于心脏，产生异常兴奋，可致心律失常，甚至引起室颤而死亡。（二）中毒表现 ：1.神经系统：表现为口舌、四肢及全身麻木，头痛，头晕，精神恍惚，语言不清或小便失禁，继而四肢抽搐、牙关紧闭、呼吸衰竭等。2.循环系统：表现为心悸气短、心律失常、血压下降、面色苍白、口唇发绀、四肢厥冷等。3.消化系统：表现为流涎、恶心、呕吐、腹痛、腹泻、肠鸣音亢进。二、马钱子及含马钱子的中成药：（一）含马钱子的中成药：九分散、山药丸、舒筋丸（B错）、疏风定痛丸、伤科七味片等。（一）中毒机制：马钱子含番木鳖碱即士的宁，毒性大。成人服用5～10mg即可中毒，一次服用30mg即可致死。番木鳖碱首先兴奋中枢神经系统，引起脊髓强直性痉挛，继而兴奋呼吸中枢及血管运动中枢。（二）中毒表现 ：初期出现头晕、头痛、烦躁不安、面部肌肉紧张、吞咽困难；进而伸肌与屈肌同时做极度收缩，发生典型的士的宁惊厥、痉挛，甚至角弓反张，可因呼吸肌痉挛窒息或心力衰竭而死亡。三、蟾酥及含蟾酥的中成药：（一）含蟾酥的中成药：六神丸、六应丸、喉症丸、梅花点舌丸、麝香保心丸、麝香通心滴丸等。（一）中毒机制：主要毒性成分是强心苷（蟾酥毒素），还含有儿茶酚胺类化合物、肾上腺素、去甲肾上腺素等。蟾蜍毒素有洋地黄样作用，小剂量能使心肌收缩力增强，大剂量则使心脏停止于收缩期。（二）中毒表现 ：1.循环系统：表现为胸闷、心律失常、脉缓慢无力、心电图显示房室传导阻滞等。严重时面色苍白、口唇发绀、四肢厥冷、大汗虚脱、血压下降、休克，甚至心搏骤停而死亡。2.消化系统：表现为恶心呕吐、腹痛、腹泻等。四、雄黄及含雄黄的中成药：（一）含雄黄的中成药：牛黄解毒丸（片）、六神丸、喉症丸、安宫牛黄丸、牛黄清心丸、牛黄镇惊丸、牛黄抱龙丸、牛黄至宝丸（C错）、追风丸、牛黄醒消丸、紫金锭（散）、三品等。（一）中毒机制：雄黄主要成分含二硫化二砷，此外还含有少量三氧化二砷。砷盐毒性较大，进入体内后，蓄积和分布于体内各组织，主要分布在肝、肾、脾等内脏及指甲、毛发等部位。砷对机体的毒性作用是多方面的，首先危害神经细胞，使中枢神经中毒，产生一系列中毒症状，并直接影响毛细血管通透性。也可使血管舒缩中枢麻痹，而导致毛细血管扩张，并可引起肝、肾、脾、心脏等血管的脂肪变性和坏死。（二）中毒表现 ：1.消化系统表现为口腔咽喉干痛、烧灼感，口中有金属味，流涎，剧烈恶心呕吐、腹痛腹泻，严重时类似霍乱。2.各种出血症状，如吐血、咯血、眼结膜充血、鼻衄、便血、尿血等。3.肝肾功能损害而引起转氨酶升高、黄疸、血尿、蛋白尿等。4.严重者因心力衰竭、呼吸衰竭而死亡。5.长期接触可引起皮肤过敏，出现丘疹、疱疹、痤疮样皮疹等。五、含朱砂、轻粉、红粉的中成药：（一）含朱砂、轻粉、红粉的中成药：牛黄清心丸、牛黄抱龙丸、抱龙丸、朱砂安神丸、天王补心丸、安神补脑丸、苏合香丸、人参再造丸（D错）、安宫牛黄丸、牛黄千金散、牛黄镇惊丸、紫雪散、梅花点舌丸、紫金锭（散）、磁朱丸、更衣丸、复方芦荟胶囊。（一）中毒机制：此类药物含汞，属汞中毒。机体吸收后迅速弥散到各个器官和组织，并可通过血-脑屏障进入脑组织，产生各种中毒症状。（二）中毒表现 ：1.消化系统表现为恶心呕吐、腹痛腹泻、口中有金属味、流涎、口腔黏膜充血、牙龈肿胀溃烂等。2.泌尿系统表现为少尿、蛋白尿，严重者可发生急性肾功能衰竭。3.神经系统及精神方面症状。